妊娠剧烈呕吐不能进食者，为预防Wernicke综合征，应补充的维生素是
A. 维生素A
B. 维生素C
C. 维生素B₁
D. 维生素E
E. 维生素B₆

正确答案：C。维生素B₁

解析：Wernicke脑病一般在妊娠剧吐持续3周后发病，为严重呕吐引起维生素B₁（C对）严重缺乏所致。临床表现为眼球震颤、视力障碍、步态和站立姿势受影响，可发生木僵或昏迷甚至死亡。纠正脱水及电解质紊乱时也需要补充维生素B₆（E错）、维生素C（B错），但与预防Wernicke综合征无关。单纯妊娠剧吐一般不需补充维生素A（A错）、维生素E（D错）。